男孩，1岁。近2个月夜间睡眠打鼾，侧卧好转，感冒时加重。患儿近日出现感冒发烧症状，打鼾加重，无呼吸暂停，这时最典型的体征是
A. 三凹征
B. 气促
C. 呼气相哮鸣音
D. 双肺细湿啰音
E. 发绀

正确答案：A。三凹征

解析：患儿咽扁桃体肥大，近日出现感冒发烧症状，打鼾加重，考虑机体感染导致咽扁桃体进一步肿大。婴幼儿本身咽腔即狭小且垂直，咽扁桃体肿大可明显阻塞上呼吸道，造成吸气性呼吸困难，因此此时最典型的体征是“三凹征”（A对）。气促（B错）、呼气相哮鸣音为支气管哮喘等终末期支气管病变的典型体征。双肺细湿啰音（D错）为下呼吸道感染的典型体征。